下列提示乙型肝炎有较强传染性的血清学检查结果是
A. 抗-HBe阳性，抗-HBc阳性
B. HBsAg阳性，抗-HBc阳性
C. 抗-HBs阳性，抗-HBe阳性，抗-HBc阳性
D. HBsAg阳性，HBeAg阳性，抗-HBc阳性
E. 抗-HBc阳性

正确答案：D。HBsAg阳性，HBeAg阳性，抗-HBc阳性